患者，男，20岁。突然呕吐下利，便质清稀，无明显腹痛及里急后重，四肢清冷，胸膈痞闷，舌苔白腻，脉濡弱。治疗应首选
A. 附子理中丸
B. 五苓散
C. 独参汤
D. 蚕矢汤
E. 藿香正气散合纯阳正气丸

正确答案：E。藿香正气散合纯阳正气丸

解析：患者突然下利，便质清稀，为泄泻。外感寒湿或风寒之邪，侵袭肠胃，或过食生冷，脾失健运，升降失调，清浊不分，饮食不化，传导失司，故大便清稀，寒湿困脾故脘闷食少，舌苔白腻，脉濡弱也为寒湿困脾之象，治法为散寒化湿，方药选用藿香正气散合纯阳正气散加减（E对）。附子理中丸（A错）可以温阳去寒，益气健脾，治疗脾胃虚寒较甚，或脾肾阳虚证。五苓散（B错）可以利水渗湿，温阳化气，治疗伤寒太阳膀胱蓄水证、水湿内停之水肿，泄泻，小便不利、痰饮内停。独参汤（C错）可以大补元气，治疗元气虚脱，肢冷汗出，脉微细欲绝。蚕矢汤（D错）可以清热利湿，升清降浊，治疗湿热内蕴之霍乱。